多见于儿童或青年人，病变进展较快，病变组织颜色较浅，呈浅棕色，质地较软且湿润，很容易用挖匙挖除的龋坏称为
A. 平滑面龋
B. 窝沟龋
C. 邻面龋
D. 慢性龋
E. 急性龋

正确答案：E。急性龋

解析：本题考查龋病的分类。多见于儿童或青年人，病变进展较快，病变组织颜色较浅，呈浅棕色，质地较软且湿润，很容易用挖匙挖除的龋坏称为急性龋（E对）。慢性龋（D错）进展慢，龋坏组织染色深，呈黑褐色，病变组织较干硬，又称干性龋，一般龋病都属此种类型。平滑面龋（A错）为除窝沟外的牙面发生的龋病损害，可进一步分为两个亚类：发生于近远中触点处的损害称为邻面龋（C错）；发生于牙颊或舌面，靠近釉牙骨质界处的损害为颈部龋。牙釉质平滑面龋病损害呈三角形，其底朝牙釉质表面，尖向牙本质，当损害达到釉牙本质界时，损害沿釉牙本质界部位向侧方扩散，在正常牙釉质下方逐渐发生潜行性破坏。窝沟龋（B错）限指磨牙和前磨牙咬合面、磨牙颊面沟和上颌前牙舌面的龋损。这些不规则的表面，缺少自洁作用，对龋病更具敏感性，在窝沟发生龋坏时，损害并非从窝沟基底部位开始，而是首先在窝沟侧壁产生损害，最后扩散到基底，龋损沿着釉柱方向发展而加深，达到牙本质，然后沿釉牙本质界扩散。